患者，男，43岁。两耳轰鸣，按之不减，听力减退，兼见烦躁易怒，咽干，便秘，脉弦，治疗应首选
A. 手、足太阴经穴
B. 手、足少阴经穴
C. 手、足少阳经穴
D. 手阳明经穴
E. 足太阳经穴

正确答案：C。手、足少阳经穴

解析：该患者两耳轰鸣，按之不减，听力减退，可诊断为耳聋、耳鸣。兼见烦躁易怒、咽干、便秘、脉弦，可辨证为肝胆火盛。手、足少阳两经经脉均入于耳中，取少阳经经穴可疏通少阳经络，清肝泻火（C对）。手、足少阴经为耳鸣、耳聋虚证为主（B错）。手阳明经以前额疼痛为主（D错）。足太阳经以后头部疼痛为主（E错）。手、足太阴经以脾胃病为主（A错）。